心理卫生又称为
A. 心理健康
B. 心理和谐
C. 心理宽容
D. 心理调节
E. 心理平衡

正确答案：A。心理健康

解析：心理健康，也称心理卫生（A对）。对心理健康进行定义是一个较为复杂而困难的问题，到目前为止心理健康与不健康之间还没有一个确定的、绝对的界限。由于心理涉及的范围广泛，包括思维、情绪、兴趣、能力等各个方面，心理学家们从不同的角度提出不同的观点，给出不同的定义。而且心理健康的概念随时代的变迁、社会文化因素的影响而不断变化。一般认为心理健康是以积极的、有效的心理活动，平稳的、正常的心理状态，对当前和发展着的社会、自然环境以及自我内环境的变化具有良好的适应功能，并由此不断地发展健全的人格，提高生活质量，保持旺盛的精力和愉快的情绪。